公共场所卫生监督的内容不包括
A. 选址
B. 微小气候
C. 卫生许可证的更新
D. 人群流动
E. 从业人员健康

正确答案：D。人群流动

解析：本题考查公共场所卫生监督的内容。公共场所卫生监督是指卫生行政部门依照国家有关卫生法规的规定对公共场所进行的预防疾病、保障健康的卫生监督检查工作。其内容包括：选址（A对）、微小气候（B对）、卫生许可证的更新（C对）、从业人员健康（E对）等。人群流动（D错，为本题正确答案）不属于公共场所卫生监督的内容，它是指人们离开原来的工作岗位，走向新的工作岗位的过程。